某保健所的工作人员从一项调查的结果中发现，6～8岁的儿童的患龋率明显低于前几个年龄段的儿童。你认为这一结果产生的原因是
A. 6～8岁的儿童的牙齿本身的抗龋能力强
B. 6～8岁儿童口腔中的唾液流量增多，有助于抑制龋病的发生
C. 6～8岁儿童养成了刷牙的好习惯
D. 6～8岁儿童吃糖的频率下降
E. 6～8岁儿童处于乳恒交替的时期

正确答案：E。6～8岁儿童处于乳恒交替的时期